24岁，初产妇。妊娠38周，规律宫缩7小时。血压110/70mmHg，骨盆不小，预测胎儿体重为2800g，枕左前位，胎心良。肛查宫口开大4cm，S=0。本例正确处置应是
A. 不需干涉产程进展
B. 人工破膜
C. 静脉缓注25%硫酸镁16ml
D. 静脉滴注缩宫素
E. 静脉推注地西泮10mg

正确答案：A。不需干涉产程进展

解析：初产妇，妊娠38周，规律宫缩7小时（正常值<8h），血压110/70mmHg（正常值为90～140/60～90mm/Hg），骨盆不小，预测胎儿体重为2800g，枕左前位，胎心良（提示胎儿良好），肛查宫口开大4cm，S=0（提示处于第一产程活跃期），该产妇处于正常产程且胎儿良好，所以正确处置应是不需干涉产程进展（A对），宫颈口开大≥3cm而2-4小时宫颈扩张无进展，应给予人工破膜（B错）和缩宫素静脉（D错）滴注加强产力，静脉缓注25%硫酸镁16ml（C错）及静脉推注地西泮10mg（E错）主要用于子痫的治疗，该患者并不存在子痫。